属于一级信息源的文献是
A. 中国药典
B. 中国国家处方集
C. 中国药学年鉴中的资料
D. 中国药典临床应用须知
E. 中国药学杂志中的研究论文

正确答案：E。中国药学杂志中的研究论文

解析：本题考查药物信息的分类。中国药学杂志中的研究论文（E对）为原创性论著，属于一级信息源。中国药典（A错）、中国国家处方集（B错）、中国药学年鉴中的资料（C错）、中国药典临床应用须知（D错）均为三级信息源。